四逆散中一升一降配伍的药物是
A. 柴胡配芍药
B. 柴胡配甘草
C. 柴胡配枳实
D. 芍药配甘草
E. 枳实配芍药

正确答案：C。柴胡配枳实

解析：四逆散能透邪解郁，疏肝理脾，主治阳郁厥逆与肝脾不和证，其中柴胡性味辛散，枳实下气，二者一升一降以调气机（C对E错）；柴胡升发阳气，疏肝解郁，透邪外出，白芍敛阴，养血柔肝，两者配伍，可使柴胡升散而无耗伤阴血之弊（A错）；甘草调和诸药，益脾和中（B错），与白芍配伍，则酸甘化阴，缓急止痛（D错）。